下列选项中，叩诊时可出现过清音的是
A. 肺气肿
B. 气胸
C. 肺炎
D. 胸腔积液
E. 肺实变

正确答案：A。肺气肿

解析：清音是正常肺部的叩诊音。过清音常见于肺组织含气量增多、弹性减弱时，比如肺气肿（A对）。浊音可见于叩击被少量含气组织覆盖的实质脏器时，或见于肺组织含气量减少的病理状态下，如肺炎（C错）。鼓音正常情况下可见于胃泡区和腹部，病理情况下可见于肺内空洞、气胸、气腹等（B错）。实音生理情况下可见于叩击心脏和肝脏等实质脏器时，在病理状态下可见于大量胸腔积液或肺实变等（DE错）。